足少阳胆经悬钟穴位于
A. 外踝下缘中点上3寸，腓骨后缘
B. 外踝前缘中点上3寸，腓骨后缘
C. 外踝后缘中点上3寸，腓骨后缘
D. 外踝高点上3寸，腓骨后缘
E. 外踝高点上3寸，腓骨前缘

正确答案：E。外踝高点上3寸，腓骨前缘

解析：悬钟为八会穴之髓会，位于小腿外侧，外踝高点上3寸，腓骨前缘（E对）；【主治】①痴呆、中风等髓海不足疾患；②颈项强痛，胸胁满痛，下肢痿痹。